患者，女性，42岁，舌苔部有一红色斑块一年余，病损时常变换位置，无自觉症状。根据上述症状，患者最可能的诊断是
A. 裂纹舌
B. 贫血性舌炎
C. 游走性舌炎
D. 沟纹舌
E. 消化不良性舌炎

正确答案：C。游走性舌炎

解析：本题考查游走性舌炎的诊断。患者，女性，42岁（中年女性），舌苔部有一红色斑块一年余（病损黏膜发红），病损时常变换位置（病变位置变化），无自觉症状，综合考虑诊断为游走性舌炎（C对）。游走性舌炎又称为地图舌，因病损的萎缩与修复同时发生的特点，使病变位置和形态不断变化，似在舌背“游走”。裂纹舌（A错）是指舌面上出现横向裂纹，见于Down病（先天愚型）与核黄素缺乏，后者有舌痛，纵向裂纹见于梅毒性舌炎。贫血性舌炎（B错）是指由多种贫血引起的舌黏膜的萎缩性改变，舌黏膜表面的丝状乳头、菌状乳头相继萎缩消失。沟纹舌（又称皱褶舌）（D错），表现为在舌背上出现一道道深沟。消化不良性舌炎（E错）主要表现为舌面成片发红及光滑，一般位置不会一直发生变化。